用双盲法进行临床试验可以减少
A. 易感性偏倚
B. 信息偏倚
C. 入院率偏倚
D. 混杂偏倚
E. 选择偏倚

正确答案：B。信息偏倚